下列除哪项外，均可为正常的叩诊音
A. 震水音
B. 清音
C. 鼓音
D. 浊音
E. 实音

正确答案：A。震水音

解析：根据叩诊音的频率（高者音调高，低者音调低）、振幅（大者音响强，小者音响弱）和是否乐音（有规律的振动、音律和谐）的不同，临床上可分为清音、鼓音、过清音、浊音和实音五种，其中清音（B对）、鼓音（C对）、浊音（D对）、实音（E对）均可为正常的叩诊音。震水音（A错，为本题正确答案）提示胃内有多量液体和气体存留，可见于幽门梗阻或胃扩张。